肺的募穴所属的经脉是
A. 脾经
B. 肾经
C. 肺经
D. 任脉
E. 胃经

正确答案：C。肺经

解析：该题主要考察募穴的分布。募穴分布于胸腹部，是脏腑经气输注和汇聚的部位。中府为肺之募穴，而中府为手太阴肺经腧穴（C对）。募穴歌诀：大肠天枢肺中府，小肠关元心巨阙，膀胱中极肾京门，肝募期门胆日月，胃募中脘脾章门，三焦募在石门穴，膻中气会何经募，心主包络厥阴也。